患儿，男，2岁。起病急骤，皮肤出现瘀斑瘀点，色红鲜明，伴有齿衄鼻衄，偶见尿血，面红目赤，心烦口渴，便秘尿少，舌红，苔黄，脉数。其首选方剂是
A. 犀角地黄汤
B. 归脾汤
C. 大补阴丸合茜根散
D. 桃仁汤
E. 参苓白术散

正确答案：A。犀角地黄汤

解析：免疫性血小板减少症…血热伤络【证候】起病急骤，皮肤出现瘀斑瘀点，色红鲜明，伴有齿衄鼻衄，偶有尿血，面红目赤，心烦口渴，便秘，舌红，苔黄，脉数。治法：清热解毒，凉血止血。方药：犀角地黄汤加减（A对）。归脾汤具有益气健脾，摄血养血的功效，用于治疗气不摄血证，症见皮肤、黏膜瘀斑瘀点反复发作，颜色暗淡，伴鼻衄齿衄，神疲乏力，面色萎黄或苍白无华，食欲不振，大便溏泄，头晕心悸，舌淡红，苔薄，脉细弱（B错）；大补阴丸合茜根散具有滋阴清热，凉血宁络的功效，用于治疗阴虚火旺证，症见皮肤黏膜散在瘀点瘀斑，下肢尤甚，时发时止，颜色鲜红，伴齿衄、鼻衄或尿血，低热盗汗，手足心热，心烦颧红，口干咽燥，舌红少苔，脉细数（C错）；桃仁汤具有活血祛瘀的功效，可以治跌打损伤，胸腹中有瘀血，呼吸周难者（D错）；参苓白术散具有益气健脾、除湿止泻的功效，用于治疗脾胃虚弱，食少便溏，气短咳嗽，肢倦乏力者（E错）。